哪个不是股骨的结构
A. 小转子
B. 髁间窝
C. 髁间隆起
D. 粗线
E. 收肌结节

正确答案：C。髁间隆起

解析：髁间隆起是胫骨的结构（C错，为本题正确答案）。小转子（A对）、髁间窝（B对）、粗线（D对）、收肌结节（E对）是股骨的结构。